患者，女性，55岁。自幼起发作性喘息，发作时经“氨茶碱，地塞米松”静脉推注可缓解，近1周来症状再发并加重急诊。查体：神清，端坐呼吸，三凹征（+），心率120次/分，P₂＞A₂，双肺未闻及哮鸣音及湿啰音。患者最可能的诊断是
A. 左心衰竭
B. 上气道阻塞
C. 慢性阻塞性肺疾病（COPD）
D. 变态反应性肺浸润
E. 支气管哮喘

正确答案：E。支气管哮喘